髂外动脉
A. 起自骼内动脉
B. 在腹股沟韧带浅面续为股动脉
C. 起自腹主动脉
D. 发出直肠上动脉
E. 在腹股沟韧面深面续为股动脉

正确答案：E。在腹股沟韧面深面续为股动脉

解析：髂外动脉起自髂总动脉（AC错）。在腹股沟韧面深面（B错）续为股动脉（E对）。